“平衡膳食宝塔”提示，每日每人大豆类摄入量相当于干豆50g，其目的主要是
A. 保证膳食纤维素摄入
B. 保证水苏糖的摄入
C. 提高必需脂肪酸摄入水平
D. 提高膳食蛋白质质量
E. 补充人体必需氨损失

正确答案：D。提高膳食蛋白质质量

解析：每日每人大豆类摄入量相当于干豆50g，其目的主要是提供蛋白质、脂肪、膳食纤维，提高膳食蛋白质质量（D对）。蔬菜、水果和菌藻类保证膳食纤维素摄入（A错）。水、谷类薯类及杂豆保证水苏糖的摄入（B错）。动植物油提高必需脂肪酸摄入水平（C错）。动物性食物，包括肉、蛋、鱼、奶、蛋等补充人体必需氨损失（E错）。